29岁孕妇，妊娠32周。3周内阴道少量流血2次，今晨突然阴道流血多于月经量，无腹痛。血压13.3/10.7kpa，脉率96次/分，宫高30cm，腹围85cm，臀显露，未入盆，胎心清楚，144次/分。以下辅助检查中应先选哪一项对诊断意义最大
A. 血常规
B. 血小板测定
C. B超
D. X线摄片
E. 阴道检查

正确答案：C。B超

解析：青年初孕妇，妊娠32周（妊娠28周及以后为妊娠晚期），出现阴道流血，无腹痛（前置胎盘的典型表现为无诱因、无痛性阴道流血），因此该孕妇可考虑为前置胎盘。B超可清楚显示子宫壁、胎盘、胎先露部及宫颈的位置，并根据胎盘下缘与宫颈内口的关系，确定前置胎盘的类型，因此对诊断意义最大（C对）。血常规（A错）和血小板（B错）测定属于一般性检查。X线摄片（D错）不能确诊前置胎盘，并且X线有辐射，对母体和胎儿有害。阴道检查（E错）能诱发阴道出血，会影响判断。